用于治疗妊娠呕吐、脂溢性皮炎、糙皮病等的药物是
A. 维生素A醋酸酯
B. 维生素B₁
C. 维生素K₃
D. 维生素B₂
E. 维生素B₆

正确答案：E。维生素B₆

解析：本题考查各型维生素的临床作用。维生素B₆（E对）可用于治疗维生素B₆缺乏症，症状表现为眼、鼻和口部皮肤脂溢样皮肤损害，糙皮病。维生素A醋酸酯（A错）可用于治疗维生素A缺乏症，如夜盲症。维生素B₁（B错）主要用于维生素B₁缺乏的预防和治疗，如“脚气病”，周围神经炎及消化不良；妊娠或哺乳期，甲状腺功能亢进，烧伤，长期慢性感染，重体力劳动，吸收不良综合征伴肝胆疾病。维生素K₃（C错）为促凝血药。维生素B₂（D错）可用于治疗维生素B₂缺乏症，如咽喉炎和口角炎，舌炎、唇炎（红色剥脱苔）、面部脂溢性皮炎。